受精卵开始着床一般开始于受精的第
A. 1～3天
B. 4～5天
C. 6～7天
D. 9～10天
E. 11～12天

正确答案：C。6～7天

解析：受精后第6～7日，晚期胚泡透明带消失后逐渐埋入子宫内膜并被其覆盖的过程称为受精卵着床（植入）。掌握“妊娠生理”知识点。